墨旱莲除能凉血止血外，又能
A. 散瘀消痈
B. 解毒敛疮
C. 清热利尿
D. 祛痰止咳
E. 滋阴益肾

正确答案：E。滋阴益肾

解析：本题考查的是墨旱莲的功效。墨旱莲除能凉血止血外，又能滋阴益肾（E对）。墨旱莲：【功效】滋阴益肾，凉血止血。大蓟：【功效】凉血止血，散瘀消痈（A错）。地榆：【功效】凉血止血，解毒敛疮（B错）。白茅根：【功效】凉血止血，清热生津，利尿（C错）通淋。侧柏叶：【功效】凉血止血，祛痰止咳（D错），生发乌发。